三羧酸循环中草酰乙酸的来源是
A. 丙酮酸羧化
B. 乙酰CoA缩合
C. 糖原分解
D. 黄嘌呤氧化
E. 糖原合成

正确答案：A。丙酮酸羧化

解析：三羧酸循环中的草酰乙酸主要来自丙酮酸的直接羧化（A对），也可通过苹果酸脱氢生成。柠檬酸循环的各中间产物在反应前后质量不发生改变，不可能通过柠檬酸循环从乙酰CoA缩合（B错）成草酰乙酸。糖原分解（C错）、黄嘌呤氧化（P228）（D错）及糖原合成（E错）过程中均不能产生草酰乙酸。